确诊伤寒常用的实验室检查是
A. 粪便检查
B. 胆汁培养
C. 血培养
D. 肥大反应
E. 粪便培养

正确答案：C。血培养

解析：伤寒是由伤寒杆菌引起的一种急性肠道传染病，对疑似患者进行血培养或骨髓培养有重要的确诊意义（C对）。血培养一般在病程第1周和第2周时阳性率最高，可达80～90%，第2周以后会逐步下降。骨髓培养在病程中出现阳性的时间和血培养相仿，不过骨髓培养的阳性率比血培养稍高一些，对于血培养阴性或者使用过抗菌药物诊断有困难的疑似患者，进行骨髓培养更有助于诊断。此外，进行粪便培养或玫瑰疹刮取液培养，也有一定的确诊意义。